含三氮唑结构临床口服给药的用于治疗深部真菌感染的药物有
A. 酮康唑
B. 硝酸咪康唑
C. 氟康唑
D. 伏立康唑
E. 伊曲康唑

正确答案：C、D、E。氟康唑；伏立康唑；伊曲康唑

解析：本题考查含有三氮唑结构的药物。含三氮唑结构临床口服给药的用于治疗深部真菌感染的药物有氟康唑（C对）、伊利康唑（D对）、伊曲康唑（E对）。唑类抗真菌药是一类化学合成的小分子化合物，根据其五元母环上的氮原子数目，又分为咪唑类和三唑类。咪唑类药物包括联苯苄唑、克霉唑、硝酸咪康唑（B错）、酮康唑（A错），三唑类药物包括氟康唑、伊曲康唑、伏立康唑、泊沙康唑等，是一类抑菌剂，部分药在高浓度时也有杀菌作用。